以下片剂辅料中，主要起崩解作用的是
A. 羟丙甲纤维素（HPMC）
B. 淀粉
C. 羧甲淀粉钠(CMS-Na）
D. 糊精
E. 羧甲纤维素钠（CMC-Na）

正确答案：C。羧甲淀粉钠(CMS-Na）

解析：本题考查崩解剂。崩解剂系指促使片剂在胃肠液中迅速破裂成细小颗粒的辅料。常用的崩解剂有：干淀粉、羧甲基淀粉钠（CMS-Na）（C对）、低取代羟丙基纤维素、交联羧甲基纤维素钠（CCMC-Na）、交联聚维酮（PVPP）和泡腾崩解剂（碳酸氢钠和枸橼酸组成的混合物，也可以用柠檬酸、富马酸与碳酸钠、碳酸钾、碳酸氢钾）等。羟丙甲纤维素（HPMC）（A错）、羧甲纤维素钠（CMC-Na）（E错）为黏合剂。淀粉（B错）、糊精（D错）为稀释剂。